男，12岁。反复左腰部胀痛2年。查体：左腰部包块，质软，呈囊性感。B超提示左肾积水，肾皮质变薄。为了解左肾实质损害程度及分析肾功能，首选的检查是
A. KUB
B. 血BUN、Cr
C. CT平扫
D. 放射性核素肾显像
E. 逆行尿路造影

正确答案：D。放射性核素肾显像

解析：排泄性尿路造影（或静脉尿路造影IVU）和放射性核素肾显像（D对）可以用来了解肾实质损害程度及分侧肾功能。KUB（肾输尿管膀胱摄影）常用于尿路结石的检查，用于了解有无尿路结石（P516）（A错）。血BUN、Cr表示肾实质损害程度，但不能了解分侧肾功能（B错）。CT平扫适用于鉴别肾囊肿和肾实质性病变确定肾损伤范围和程度，不能了解分侧肾功能（P516）（C错）。逆行尿路造影可了解尿液外溢情况，观察尿路内各种结石，适用于肾功能不全、顺行尿路造影显像不明显者（E错）。